某男，58岁，BMI为29，喜食肉多年，颈动脉B超示：“双侧颈动脉粥样硬化并粥样斑块形成”。其营养治疗应注意
A. 限制脂肪摄入
B. 限制胆固醇摄入
C. 严格限制胆固醇和控制总能量摄入
D. 限制饱和脂肪的摄入
E. 限制总能量、总脂肪、饱和脂肪和胆固醇摄入

正确答案：E。限制总能量、总脂肪、饱和脂肪和胆固醇摄入

解析：本题考查动脉粥样硬化的营养治疗。本题中该男性BMI为29≥28为肥胖，且患有动脉粥样硬化，其营养治疗应注意限制总能量、总脂肪、饱和脂肪和胆固醇摄入（E对ABCD错）。